长期服用可以引起老年人出现抑郁等症状的药物是
A. 氯氮䓬（利眠宁）
B. 苯海索（安坦）
C. 呋塞米（速尿）
D. 泼尼松（强的松）
E. 溴丙胺太林（普鲁本辛）

正确答案：A。氯氮䓬（利眠宁）